女性，33岁，外阴瘙痒，刺痛伴灼热感3天，发热1天，停经30周G1P0,妇科检查：外阴散在10余直径0.2～0.5cm疱疹，部分破溃呈脓疱，最可能感染病原体及潜伏部位
A. HSV-1 骶神经节
B. HSV-2 骶神经节
C. VZV 脊髓后根神经节
D. HSV-2 三叉神经节
E. HSV-1 三叉神经节

正确答案：B。HSV-2 骶神经节

解析：HSV病毒有两个血清型，HSV1型和HSV2型。HSV1型主要侵犯人体腰部以上的器官，包括口腔、唇、眼、脑等部位，一般临床上没有明显的症状。HSV2型主要侵犯人体腰部以下的器官，主要为生殖器官。HSV-1潜伏于三叉神经节和颈上神经节；HSV-2则潜伏于骶神经节（B对）。